患者王某，15岁，因患感冒、咳嗽，到社区卫生服务中心就诊，经问诊结合血常规检查结果，医师开具了左氧氟沙星片、复方磷酸可特因口服溶液、感冒清热颗粒（外包装为红色OTC标识）的处方。药师审方后，认为左氧氟沙星片不宜用于18岁以下小儿及青少年，建议调整抗菌药物，改用阿奇霉素片。取药时，药师交代用药注意事项。感冒清热颗粒药品说明书中【成分】项下需要列出辅料名称的说法，正确的是
A. 需要列出全部辅料的名称
B. 不需要列出辅料的名称
C. 只需要列出可能出现安全风险的辅料名称
D. 只需要列出主要的辅料名称

正确答案：A。需要列出全部辅料的名称

解析：本题考查药品说明书的编写要求。说法正确的是需要列出全部辅料的名称（A对）。药品说明书的编写要求：药品说明书对疾病名称、药学专业名词、药品名称、临床检验名称和结果的表述，应当采用国家统一颁布或规范的专用词汇，度量衡单位应当符合国家标准的规定。药品说明书应当列出全部活性成分或者组方中的全部中药药味。注射剂和非处方药还应当列出所用的全部辅料名称（BD错）。药品处方中含有可能引起严重不良反应的成分或者辅料的（C错），应当予以说明。